易出血区(Little区）位于
A. 上鼻甲
B. 中鼻甲
C. 下鼻甲
D. 鼻中隔上部
E. 鼻中隔前下部

正确答案：E。鼻中隔前下部

解析：易出血区(Little区）位于鼻中隔前下部（E对）。